左旋多巴抗帕金森病的机制是
A. 抑制多巴胺的再摄取
B. 激动中枢胆碱受体
C. 阻断中枢胆碱受体
D. 补充纹状体中多巴胺的不足
E. 直接激动中枢的多巴胺受体

正确答案：D。补充纹状体中多巴胺的不足

解析：左旋多巴主要在小肠经主动转运迅速吸收，吸收后在外周被左旋芳香族氨基酸脱羧酶脱羧转化为DA，仅有约1%的左旋多巴直接进入中枢，被脑内左旋芳香族氨基酸脱羧酶脱羧转化为DA，补充纹状体DA不足（D对），产生抗帕金森病作用。中枢M胆碱受体阻断药是最早用于治疗帕金森病的药物，因阿托品和东莨胆碱治疗帕金森病时外周抗胆碱副作用大，主要使用中枢性M胆碱受体阻断药苯海索（B错），阻断中枢M胆碱受体（C错），抑制黑质-纹状体胆碱能神经功能，产生抗帕金森病作用。溴隐亭是非选择性中枢多巴胺受体激动剂（E错），对外周多巴胺受体和α受体也有弱的激动作用，大剂量激动黑质-纹状体通路的D₂受体，产生抗帕金森病作用。除了以上几种外，还有金刚烷胺等促进多巴胺释放的药物，用于治疗帕金森病，对运动障碍、肌强直、震颤均有改善作用，无抑制多巴胺的再摄取的药物（A错）。